城乡规划制度是国家法规体系的一个重要组成部分，与城乡规划相关的法律主要有
A. 中华人民共和国城乡规划法
B. 村庄和集镇规划建设管理条例
C. 城市居住区规划设计规范
D. A＋B
E. A＋B＋C

正确答案：D。A＋B

解析：本题考查与城乡规划相关的法律法规。城乡规划制度是国家法规体系的一个重要组成部分，与城乡规划相关的法律法规是城乡规划行为的依据和城乡规划实施的保证。包括：《中华人民共和国城乡规划法》、《村庄和集镇规划建设管理条例》（D对ABCE错）。